易于透过血脑屏障的化学物是
A. 分子量低、水溶性高、不与蛋白质结合
B. 分子量低、脂溶性高、不与蛋白质结合
C. 分子量低、脂溶性低、与蛋白质结合
D. 分子量高、脂溶性高、与蛋白质结合
E. 分子量高、水溶性低、与蛋白质结合

正确答案：B。分子量低、脂溶性高、不与蛋白质结合